患者，女，40岁，因停经3个月伴潮热、出汗就诊。B超示子宫内膜5mm，乳腺未见异常。否认高血压、糖尿病及血栓栓塞性疾病史。仍然希望有月经样出血，宜选用的MHT方案是
A. 雌、孕激素连续联合方案
B. 单纯孕激素补充方案
C. 单纯雄激素补充方案
D. 单纯雌激素补充方案
E. 雌、孕激素序贯方案

正确答案：E。雌、孕激素序贯方案

解析：本题考查绝经激素治疗（MHT）的常用治疗方案。雌、孕激素序贯方案（E对）适用于有完整子宫、围绝经期或绝经后仍希望有月经样出血的妇女。